儿童需要长期使用肾上腺糖皮质激素时，应当避免使用的药品是
A. 可的松
B. 泼尼松
C. 地塞米松
D. 泼尼松龙
E. 甲泼尼龙

正确答案：C。地塞米松

解析：本题考查儿童用药。激素可抑制患儿的生长和发育，确有必要长期使用时，应采用短效（如可的松）或中效制剂如（泼尼松），避免使用长效制剂（如地塞米松）（C错，为本题正确答案）。